鱼肝油乳剂处方组成：鱼肝油500ml、阿拉伯胶细粉125g、西黄蓍胶细粉7g、糖精钠0.1g、杏仁油1ml、羟苯乙酯0.5g，纯化水加至1000ml。其中用作抑菌剂的是
A. 阿拉伯胶
B. 鱼肝油
C. 杏仁油
D. 羟苯乙酯
E. 西黄蓍胶

正确答案：D。羟苯乙酯

解析：本题考查的是鱼肝油乳剂。鱼肝油乳剂处方组成：鱼肝油500ml、阿拉伯胶细粉125g、西黄蓍胶细粉7g、糖精钠0.1g、杏仁油1ml、羟苯乙酯0.5g，纯化水加至1000ml。其中用作抑菌剂的是羟苯乙酯（D对）。鱼肝油乳剂：【注解】处方中鱼肝油（B错）为药物，兼作油相；阿拉伯胶（A错）为乳化剂；西黄蓍胶（E错）为稳定性；糖精钠和杏仁油（C错）为矫味剂；羟苯乙酯为防腐剂。本品用于预防和治疗维生素A及维生素D缺乏症。